制备包合物常用的包合材料是
A. 明胶
B. 乙基纤维素
C. 磷脂
D. 聚乙二醇
E. β-环糊精

正确答案：E。β-环糊精

解析：本题考查包合材料。制备包合物常用的包合材料是环糊精（E对）及其衍生物。